下列指数中常用来描述牙周状况的是
A. DMFT
B. dmfs
C. CPI
D. Dean指数
E. DMFS

正确答案：C。CPI

解析：本题考查评价牙周健康的指数。下列指数中常用来描述牙周状况的是CPI（C对）。CPI是社区牙周指数，检查内容为牙龈出血、牙石和牙周袋深度；用于描述牙周状况。恒牙龋失补牙数（DMFT）（A错）、恒牙龋失补牙面数（DMFS）（E错）、乳牙龋失补牙数（dmft）、乳牙龋失补牙面数（dmfs）（B错）为评价龋病的常用指数。Dean指数（D错）为氟牙症诊断标准。